细菌性阴道病的首选治疗药物是
A. 头孢菌素
B. 青霉素
C. 制菌霉素
D. 阿奇霉素
E. 甲硝唑

正确答案：E。甲硝唑

解析：细菌性阴道病是阴道菌群失调所致的一种混合感染，以厌氧菌居多。甲硝唑主要用于治疗或预防厌氧菌引起的系统或局部感染，且不影响乳杆菌生长，故细菌性阴道病的首选治疗药物是甲硝唑（E对）。头孢菌素（A错）、青霉素（B错）主要对革兰氏阳性菌有效。制菌霉素（P250）（C错）主要用于治疗外阴阴道假丝酵母菌病。阿奇霉素（D错）主要用于治疗由支原体、衣原体感染。